男性，21岁。近半年来反复心悸胸痛劳力性呼吸困难。时有头晕或短暂神志丧失。体检发现：心脏轻度增大，心尖部有2级收缩期杂音和第四心音，胸骨左缘第3～4肋间闻及较粗糙的喷射性收缩期杂音。应选用的药物是
A. 地高辛
B. 硝酸甘油
C. 心得安（普萘洛尔）
D. 卡托普利
E. 双氢克尿噻

正确答案：C。心得安（普萘洛尔）

解析：患者青年男性，反复心悸、胸痛、劳力性呼吸困难，时有头晕或短暂神志丧失，体检发现：心脏轻度增大，心尖部有2级收缩期杂音和第四心音，胸骨左缘第3～4肋间闻及较粗糙的喷射性收缩期杂音（提示流出道梗阻），考虑诊断为肥厚型梗阻性心肌病。此时应选用的药物是心得安（普萘洛尔）（C对）。心得安（普萘洛尔）为β受体拮抗剂，可改善心肌松弛，增加心室舒张期充盈时间，减少室性及室上性心动过速，为肥厚型梗阻性心肌病的首选用药。地高辛（A错）为洋地黄制剂，可增强心肌收缩力，而肥厚型梗阻性心肌病主要是舒张功能受损，若服用地高辛可加重患者症状。硝酸甘油（B错）为硝酸酯类药物，扩张小静脉，减轻心脏前负荷，可加重心室流出道梗阻，不能用于肥厚型梗阻性心肌病患者的治疗。卡托普利（血管紧张素转换酶抑制剂）（D错）和双氢克尿噻（氢氯噻嗪）（E错）主要用于合并心力衰竭患者的治疗。